腺样囊性癌常沿什么扩散
A. 神经
B. 淋巴结
C. 血液
D. 骨膜
E. 筋膜

正确答案：A。神经

解析：腺样囊性癌的肿瘤易沿神经扩散，肿瘤浸润性极强。掌握“腺样囊性癌”知识点。